口淡乏味多见于
A. 肝胆实热
B. 脾胃湿热
C. 肝胃蕴热
D. 食积内停
E. 脾虚不运

正确答案：E。脾虚不运

解析：本题考查的是口味异常的临床意义。口淡乏味多见于脾虚不运（E对）。口味异常的临床意义，主要是询问患者口中的异常味觉与气味。口苦，多见于热证，特别是常见于肝胆实热的病变；口甜而腻，多属脾胃湿热（B错）；口中泛酸，多为肝胃蕴热（C错）；口中酸馊，多为食积内停（D错）；口淡乏味，常见于脾虚不运。